桑菊感冒片的功能是
A. 疏风解表
B. 宣肺止咳
C. 解表通里
D. 解肌清热
E. 益气解表

正确答案：B。宣肺止咳

解析：本题考查的是桑菊感冒片的功能。桑菊感冒片的功能是宣肺止咳（B对）。桑菊感冒片：【功能】疏风清热，宣肺止咳。银翘解毒丸：【功能】疏风解表（A错），清热解毒。防风通圣丸：【功能】解表通里（C错），清热解毒。葛根芩连丸：【功能】解肌透表，清热（D错）解毒，利湿止泻。参苏丸：【功能】益气解表（E错），疏风散寒，祛痰止咳。